可用于酸性和碱性溶液杀菌剂的表面活性剂是
A. 阴离子表面活性剂
B. 阳离子表面活性剂
C. 非离子表面活性剂
D. 阴离子表面活性剂与非离子表面活性剂的等量混合物
E. 阴阳离子表面活性剂等量混合物

正确答案：B。阳离子表面活性剂

解析：本题考查表面活性剂。阳离子表面活性剂（B对）在酸性或碱性溶液中均较稳定，具有良好的表面活性作用和杀菌、防腐作用；阴离子表面活性剂（A错）、非离子表面活性剂（CD错）和阴阳离子表面活性剂（E错）均不作为杀菌剂使用。